某男，68岁。患高血压病5年，冠心病1年，服用西药血压控制尚平稳。近1月时有头痛头胀、面红目赤、心烦易怒，舌红、苔少、脉细弦。证属阴虚阳亢。处方：天麻9g，钩藤12g（后下），石决明20g（先煎），生牡蛎30g（先煎），栀子6g，生白芍12g，炒杜仲12g，车前子15g（包煎），菊花12g，川芎10g，牛膝12g。服用上方2周后，症状缓解，半年后突发脑梗死，经住院治疗后，仍有手足麻木、步履艰难、口眼㖞斜、言语不清等症状。医师诊断为瘀血阻窍、脉络失养，宜选用的成药是
A. 抗栓再造丸
B. 人参再造丸
C. 复方丹参片
D. 芎菊上清丸
E. 松龄血脉康胶囊

正确答案：A。抗栓再造丸

解析：本题考查的是抗栓再造丸的主治。某男，68岁。患高血压病5年，冠心病1年，服用西药血压控制尚平稳。近1月时有头痛头胀、面红目赤、心烦易怒，舌红、苔少、脉细弦。证属阴虚阳亢。处方：天麻9g，钩藤12g（后下），石决明20g（先煎），生牡蛎30g（先煎），栀子6g，生白芍12g，炒杜仲12g，车前子15g（包煎），菊花12g，川芎10g，牛膝12g。服用上方2周后，症状缓解，半年后突发脑梗死，经住院治疗后，仍有手足麻木、步履艰难、口眼㖞斜、言语不清等症状。医师诊断为瘀血阻窍、脉络失养，宜选用的成药是抗栓再造丸（A对）。抗栓再造丸：【主治】瘀血阻窍、脉络失养所致的中风，症见手足麻木、步履艰难、瘫痪、口眼㖞斜、言语不清；中风恢复期及后遗症期见上述证候者。人参再造丸（B错）：【主治】气虚血瘀、风痰阻络所致的中风，症见口眼㖞斜、半身不遂、手足麻木、疼痛、拘挛、言语不清。复方丹参片（C错）：【主治】气滞血瘀所致的胸痹，症见胸闷、心前区刺痛；冠心病心绞痛见上述证候者。芎菊上清丸（D错）：【主治】外感风邪引起的恶风身热、偏正头痛、鼻流清涕、牙疼喉痛。松龄血脉康胶囊（E错）：【主治】肝阳上亢所致的头痛、眩晕、急躁易怒、心悸、失眠；高血压及原发性高脂血症见上述证候者。